右上6左上678缺失，可选择何种形式的连接体
A. 腭杆
B. 腭板
C. 舌托
D. 舌面板
E. 树脂基托

正确答案：A。腭杆

解析：后腭杆：位于上颌硬区之后，颤动线之前，两端微弯向前至第一、第二磨牙之间。掌握“局部义齿连接体”知识点。